下列选项中属于秦艽功效的是
A. 祛风除湿，活血通络，消肿止痛，杀虫解毒
B. 祛风湿，止痛，利水消肿
C. 祛风湿，退虚热，清湿热，通络止痛
D. 祛风湿，补肝肾，强腰膝
E. 祛风湿，通络止痛，消骨鲠

正确答案：C。祛风湿，退虚热，清湿热，通络止痛

解析：秦艽味辛、苦，性平，归胃、肝、胆经。辛散苦燥，善散风除湿，性质平和，柔润不燥，可舒筋活络。由于质地偏润，祛风不燥，被誉为：“风药中之润剂，散药中之补剂”。且能清虚热，除湿热，止痹痛（C对）。